糖尿病与牙周病的可能关系是
A. 糖尿病是牙周病的危险因素之一
B. 牙周病不会影响糖尿病
C. 糖尿病与牙周病之间存在双向关系
D. A+B
E. A+C

正确答案：E。A+C

解析：本题考查糖尿病与牙周病的关系。流行病调查研究表明糖尿病患者牙周炎范围和程度均高于无糖尿病者，Ⅱ型糖尿病是仅次于年龄、牙结石的第三位牙周炎危险因素（A对）。血糖控制不良，牙周组织的炎症较重，血糖控制后，牙周炎的情况会有所好转，胰岛素的用量减少（B错），所以糖尿病和牙周病之间存在双向关系（C对）（AC均对，故E为本题的正确答案）。